有明显耳毒性的药物是
A. 青霉素
B. 链霉素
C. 磺胺嘧啶
D. 四环素
E. 氯霉素

正确答案：B。链霉素

解析：本题考查链霉素的不良反应。链霉素（B对）主要不良反应为耳毒性和肾毒性。青霉素类（A错）不良反应主要为过敏反应。磺胺嘧啶（C错）不良反应为过敏反应，表现为药疹，新生儿肝功能不全。四环素（D错）类抗菌药物可引起二重感染，可与钙离子结合形成四环素牙，并影响胎儿、新生儿和婴幼儿骨骼的正常发育。氯霉素（E错）可引起严重骨髓抑制、再生障碍性贫血及灰婴综合征。